男，50岁。烦躁、昼睡夜醒2天。肝炎肝硬化病史5年。对明确意识障碍病因最有意义的实验室检查是
A. 血糖
B. ALT/AST
C. 血清蛋白电泳
D. 血氨
E. 血电解质

正确答案：D。血氨

解析：患者肝炎肝硬化病史5年（肝性脑病严重肝病基础），烦躁、昼睡夜醒2天（存在中枢神经系统功能紊乱的临床表现），通过查血氨水平（D对）可诊断肝性脑病，明确意识障碍病因。患者无糖尿病病史，血糖（A错）测定常用于诊断糖尿病酮症酸中毒。ALT/AST异常（B错）可提示肝功能受损，常用于肝炎诊断，但不能明确意识障碍病因。血清蛋白电泳（C错）常用于多发性骨髓瘤的诊断，血电解质（E错）为一般性检查，二者均不能明确意识障碍病因。